会阴深隙内不出现
A. 尿道膜部
B. 尿道球腺
C. 会阴深横肌
D. 尿道阴道括约肌
E. 尿道球部

正确答案：E。尿道球部

解析：尿道膜部（A对）、尿道球腺（B对）、会阴深横肌（C对）、尿道括约肌（D对）均为会阴深隙内的结构。尿道球部（E错，为本题正确答案）不属于会阴深隙内的结构。